患者关节红肿剧痛，入夜尤甚，壮热烦渴，舌红少津，脉弦数者，治宜选用
A. 白虎桂枝汤
B. 蠲痹汤
C. 防风汤
D. 渗湿汤
E. 犀角散

正确答案：E。犀角散

解析：风湿热邪侵袭关节，阻滞经脉故见关节红肿剧痛；热痹化火伤阴，阴虚内热故见疼痛入夜尤甚，壮热烦渴；舌红少津，脉弦数，均为热痹化火伤津之征，故治疗时应清热解毒，凉血止痛，选用犀角散加减（E对）。白虎桂枝汤（A错）治疗风湿热痹症。蠲痹汤（B错）可以祛风除湿，蠲痹止痛，用于治疗风寒湿三气合而成痹者。防风汤（C错）治疗寒湿痹症风邪偏盛者。渗湿汤（D错）治疗风寒湿痹寒邪偏盛者。